老年人，瘢痕性幽门梗阻，全身情况差，应首选的手术方式是
A. 胃大部切除术
B. 全胃切除术
C. 胃肠吻合术
D. 胃大部切除术加淋巴结清扫术
E. 高选择性迷走神经切断术

正确答案：C。胃肠吻合术

解析：国内目前仍以胃大部切除术为主，也可采用迷走神经干切断加胃窦部切除（C对）。